龋损主要发生于牙龈退缩、根面外露的老年人牙列，称为
A. 平滑面龋
B. 窝沟龋
C. 线性釉质龋
D. 根面龋
E. 隐匿性龋

正确答案：D。根面龋

解析：根面龋：龋损主要发生于牙龈退缩、根面外露的老年人牙列。掌握“龋病的临床表现与分类”知识点。